长期服用糖皮质激素的患者宜多食用的是
A. 绿叶蔬菜
B. 咖啡
C. 葡萄柚汁
D. 奶制品
E. 深海鱼油

正确答案：D。奶制品

解析：本题考查药物相互作用。长期服用糖皮质激素的患者宜多食用的是奶制品（D对）。肾上腺皮质激素类可加速体内蛋白质分解并抑制蛋白质的合成，长期服用皮质激素，宜多食高蛋白食物如奶制品，防止体内因蛋白质不足而继发其他病变。咖啡（B错）长期服用易致缺钙，诱发骨质疏松症。葡萄柚汁（C错）主要影响CYP3A4代谢并抑制CYP3A4的活性，不能与经过CYP3A4代谢的药物合用。